15岁每日能量的需求约
A. 250kJ/kg
B. 220kJ/kg
C. 4500kJ/kg
D. 360kJ/kg
E. 750kJ/kg

正确答案：A。250kJ/kg

解析：机体的新陈代谢需要能量维持，能量由食物中的营养素供给。小儿能量需要的总量为基础代谢率、生长发育、食物的热力作用、活动消耗和排泄消耗的总和。小儿能量需要的总量相对比成人多，年龄越小，需要量相对也大。1岁以内的婴儿每日所需的总热量为460kJ/kg（110kcal/kg），以后每增加3岁每日减去42kJ/kg（10kcal/kg），到15岁每日约为250kJ/kg（60kcal/kg）（A对）。